治疗肝肾阴虚，肝气郁滞证的方剂是
A. 暖肝煎
B. 逍遥散
C. 六味地黄丸
D. 四逆散
E. 一贯煎

正确答案：E。一贯煎

解析：一贯煎中重用生地黄补益肝肾之阴血为君。臣以当归、枸杞养血滋阴柔肝，北沙参、麦冬滋养肺胃，养阴生津，意在佐金平木，扶土制木。佐以少量川楝子，疏肝泄热，理气止痛，复其条达之性。诸药共奏滋阴、疏肝之功，主治肝肾阴虚，肝气郁滞证（E对）。暖肝煎功用为温补肝肾，行气止痛，主治肝肾不足，寒滞肝脉证（A错）。逍遥散功用为疏肝解郁，养血健脾，主治肝郁血虚脾弱证（B错）。六味地黄丸功用为滋补肝肾，主治肝肾阴虚证（C错）。四逆散功用为透邪解郁，疏肝理脾，主治阳郁厥逆证，或肝脾气郁证（D错）。